在碳酸氢钠试液中，与硫酸铜反应，生成蓝色配合物，转溶于三氯甲烷中显黄色
A. 异烟肼
B. 肾上腺素
C. 苯巴比妥
D. 盐酸利多卡因
E. 磺胺甲噁唑

正确答案：D。盐酸利多卡因

解析：本题考查盐酸利多卡因的鉴别。盐酸利多卡因（D对）分子中具有芳酰胺结构，可在碳酸钠试液中与硫酸铜反应，生成蓝紫色配合物，转溶于三氯甲烷中显黄色。